半边莲善治
A. 梅毒
B. 肠痈腹痛
C. 感冒发热
D. 热毒血痢
E. 毒蛇咬伤

正确答案：E。毒蛇咬伤

解析：本题考查半边莲的主治病证。半边莲善治毒蛇咬伤（E对）。半边莲【主治病证】（1）毒蛇咬伤，蜂蝎刺蜇。（2）大腹水肿，小便不利，黄疸尿少。土茯苓【主治病证】（1）梅毒（A错），或因患梅毒服汞剂而致肢体拘挛者。（2）淋浊，带下，脚气，湿疹，湿疮。牡丹皮【主治病证】（1）温病热入血分而发斑疹，血热之吐血、衄血。（2）温病后期阴虚发热，久病伤阴之无汗骨蒸。（3）血滞之闭经、痛经，产后瘀阻，癥瘕，跌打伤肿。（4）痈肿疮毒，肠痈腹痛（B错）。穿心莲【主治病证】（1）温病初起，感冒发热（C错），肺热咳喘，肺痈，咽喉肿痛。（2）痈疮疖肿，毒蛇咬伤。（3）湿热泻痢，热淋涩痛，湿疹。马齿苋【主治病证】（1）热毒血痢（D错），热毒疮疡。（2）血热之崩漏、便血。（3）热淋，血淋。